女，32岁，停经56天，3天前开始有少量断续阴道出血，昨日始右下腹轻痛，今日疼痛加剧，呕吐2次。妇检：子宫口闭，宫颈举痛（+），子宫前倾前屈，较正常稍大，软，子宫右侧可触及拇指大小较软之块物，尿hCG（±），后穹隆穿刺吸出10ml不凝血液，血象：白细胞10×109/L，中性0.8，血红蛋白75g/L，体温37.5℃，血压10/6kPa（75/45mmHg）最可能的诊断是
A. 不完全流产
B. 右卵巢黄体破裂
C. 右输卵管妊娠
D. 急性附件炎
E. 卵巢囊肿蒂扭转

正确答案：C。右输卵管妊娠

解析：停经56天，宫颈举痛（+），子宫前倾前屈，较正常稍大，软，子宫右侧可触及拇指大小较软之块物提示输卵管妊娠后穹隆穿刺吸出10ml不凝血液，血红蛋白75g/L提示破裂出血掌握“异位妊娠”知识点。